大量饮水引起尿量增多，主要是由于
A. ADH分泌减少
B. 滤过率增加
C. 醛固酮分泌减少
D. 肾素分泌减少
E. 肾血流量下降

正确答案：A。ADH分泌减少